胆红素在肝细胞内存在形式是
A. 硫酸胆红素
B. 胆红素清蛋白
C. 胆红素配体蛋白
D. 胆红素葡萄糖醛酸酯
E. 胆素原族

正确答案：C。胆红素配体蛋白